男，22岁，因呕吐咖啡色液体及黑便来诊。既往无胃病及肝病史。查体：面色稍苍白，血压100/60mmHg，心率92次/分，腹软，肝脾未触及，肠鸣音活跃。药物治疗首选
A. 质子泵阻滞剂
B. 硫糖铝
C. 生长抑素制剂
D. 胶体次枸橼酸铋
E. 米索前列醇

正确答案：A。质子泵阻滞剂

解析：青年男性患者，既往无胃病及肝病史，呕吐咖啡色液体及黑便来诊（上消化道出血的表现）。查体：面色稍苍白（考虑为上消化道出血引起贫血），血压100/60mmHg（正常血压90～120/60～80mmHg），心率92次/分（正常值60～100次/分），腹软，肝脾未触及（排除门脉高压），肠鸣音活跃（肠腔内积血，刺激肠蠕动增加）。综合患者的病史、临床表现，最可能的诊断是十二指肠溃疡并发出血。因血小板聚集及血浆凝血功能诱导的止血作用需在pH＞6.0时才能有效发挥，而且新形成的凝血块在pH＜5.0的胃液中会迅速被消化，药物治疗首选质子泵阻滞剂（A对），其抑酸作用强，可提高胃内pH值起到止血作用。生长抑素制剂（C错）为止血药物，为肝硬化胃底食管静脉曲张破裂出血的常用药，可以减少门静脉的血流量。硫糖铝（B错）、胶体次枸橼酸铋（D错）、米索前列醇（E错）为黏膜保护剂，不能达到止血效果。